某女45岁，体胖，患湿热赤白带下与血热崩漏，宜选用的药是
A. 芡实
B. 海螵蛸
C. 椿皮
D. 桑螵蛸
E. 莲子肉

正确答案：C。椿皮

解析：本题考查的是椿皮的主治病证。体胖，患湿热赤白带下与血热崩漏，宜选用的药是椿皮（C对）。椿皮：【主治病证】（1）久泻久痢，湿热泻痢，便血。（2）崩漏，赤白带下。（3）蛔虫病。（4）疮癣作痒。芡实（A错）：【主治病证】（1）脾虚久泻不止。（2）肾虚遗精，小便不禁，白带过多。海螵蛸（B错）：【主治病证】（1）崩漏下血，肺胃出血，创伤出血。（2）肾虚遗精，赤白带下。（3）胃痛吞酸。（4）湿疮湿疹，溃疡不敛。桑螵蛸（D错）：【主治病证】（1）肾阳亏虚之遗精、滑精，遗尿、尿频，小便白浊，带下。（2）阳痿不育。莲子肉（E错）：【主治病证】（1）脾虚久泻、食欲不振。（2）肾虚遗精、滑精，脾肾两虚之带下。（3）心肾不交之虚烦、惊悸失眠。